地骨皮除能退虚热外，还能
A. 凉血，生津
B. 凉血，解暑
C. 清肺，化痰
D. 祛痰，利咽
E. 活血，利咽

正确答案：A。凉血，生津

解析：本题考查的是地骨皮的功效。地骨皮除能退虚热外，还能凉血，生津（A对）。地骨皮：【功效】退虚热，凉血，清肺降火，生津。青蒿：【功效】退虚热，凉血，解暑（B错），截疟。车前子：【功效】利水通淋，渗湿止泻，明目，清肺化痰（C错）。射干：【功效】清热解毒，祛痰利咽（D错），散结消肿。功效为活血，利咽（E错）的中药，2022年考试指南未明确说明。